医生给一名30岁的女性做巴氏涂片检查，属于
A. 化学预防
B. 筛查
C. 健康咨询
D. 免疫接种
E. 药物治疗

正确答案：B。筛查

解析：巴氏涂片是指从子宫颈部取少量的细胞样品，放在玻璃片上，然后在显微镜下研究是否异常。通过简单的宫颈抹片，医生可以侦测到子宫颈细胞微小的极早期变化，这是世界上普遍使用的一种宫颈癌筛查（B对）。化学预防（A错）指对无症状者使用药物、营养素（包括矿物质）、生物制剂或其他天然物质作为第一级预防措施，提高人群抵抗疾病的能力，防止某些疾病的发生。健康咨询（C错）是通过收集就医者的健康危险因素，对个体进行有针对性的健康教育，提高就医者自我保健意识，并与就医者共同制定改变不良健康行为的计划，督促就医者执行干预计划等，促使他们自觉地采纳有益于健康的行为，消除或减轻影响健康的危险因素。免疫接种（D对）是指用人工制备的疫苗类制剂（特异性抗原）或免疫血清制剂（特异性抗体），通过适当的途径接种到机体，使人体或群体产生对某种传染病的自动免疫或被动免疫，从而保护易感人群，预防传染病发生。